婚前医学检查对患有指定传染病在传染期内的医学意见应为
A. 不宜结婚
B. 可结婚，同时治疗
C. 暂缓结婚，需先治疗
D. 可先结婚，不宜生育
E. 可结婚和生育

正确答案：C。暂缓结婚，需先治疗

解析：本题考查婚前医学检查的医学意见。根据婚前医学检查结果，患有指定传染病在传染期内，应暂缓结婚的疾病。这些对象应接受积极治疗（C对ABDE错），在治愈后或病情稳定后，婚检医师给予重新评估，最后再给出医学意见。